不是艾滋病的抗病毒治疗药是
A. 复方新诺明
B. 齐多夫定
C. 拉米夫定
D. 奥司他韦
E. 奈韦拉平

正确答案：D。奥司他韦

解析：奥司他韦（D错，为本题正确答案）是神经氨酸酶抑制剂，为特异性抑制甲、乙型流感病毒治疗药物，不是艾滋病的抗病毒治疗药。齐多夫定（B对）、拉米夫定（C对）、奈韦拉平（E对）均属核苷类反转录酶抑制剂类，是艾滋病的抗病毒治疗药。复方新诺明（A错，非本题正确答案）为磺胺类抗菌药，非抗病毒药物。